病毒性心肌炎与哪项有关
A. 人类疱疹病毒6型
B. 柯萨奇病毒A型
C. 柯萨奇病毒B型
D. 单纯疱疹病毒
E. 无正确选项

正确答案：C。柯萨奇病毒B型

解析：病毒性心肌炎常见的病原体有柯萨奇B组、孤儿（Echo）病毒，脊髓灰质炎病毒等，尤其是柯萨奇B组（C对）是最为常见的致病原因。柯萨奇A型病毒（B错）主要导致疱疹性咽峡炎、急性结膜炎、手足口病等（P254）。人类疱疹病毒6型（HHV-6）（A错）感染持续终生，多为隐性感染，少数可导致婴儿玫瑰疹（P303）。单纯疱疹病毒（HSV）（D错）可致导致口、唇、生殖器疱疹等多种疾病，如龈口炎、角膜结膜炎、新生儿感染（P295-P296）。